有关脊神经的描述,错误的是
A. 共有31对
B. 除第2--11胸神经前支外,其余各脊神经前支分别连结成丛
C. 脊神经属混合性神经
D. 脊神经后支只含躯体感觉纤维
E. 脊神经内含有4种纤维成分

正确答案：D。脊神经后支只含躯体感觉纤维

解析：脊神经共31对（A对），前根和后根在椎间孔处合为一条脊神经，由此成为既含感觉纤维又含运动纤维的混合神经（C对），含有四种纤维成分：躯体感觉纤维、内脏感觉纤维、躯体运动纤维、内脏运动纤维。除12对胸神经外，其余脊神经前支形成4个神经丛，即颈丛、臂丛、腰丛和骶丛（B对）。后支是脊神经干发出的一系列向躯干背面走行，分布于项部、背部和腰骶部的分支，亦为混合性神经支（D错，为本题正确选项）。